舒必利临床用于
A. 精神分裂症
B. 躁狂症
C. 焦虑症
D. 老年性痴呆
E. 帕金森病

正确答案：A。精神分裂症

解析：本题考查舒必利的临床应用。舒必利为苯甲酰胺类抗精神病药，临床用于精神病与精神分裂症（A对）。